深龋的临床表现，描述有误的是
A. 龋损已至牙本质深层
B. 大多数有冷热激发痛
C. 对甜酸食物较为敏感
D. 偶尔也会出现自发痛
E. 龋洞嵌入食物有疼痛

正确答案：D。偶尔也会出现自发痛

解析：本题考查深龋的临床表现。深龋的临床表现，描述有误的是偶尔也会出现自发痛（D错，为本题的正确答案）。患有深龋的牙对温度刺激也敏感，但往往是当冷、热刺激进入深龋洞内才出现疼痛反应，而刺激去除后症状并不持续。深龋病变已进展到牙本质深层（A对），大多有冷热刺激痛（B对），对甜酸食物等化学刺激较为敏感（C对），食物进入龋洞时，压迫牙髓产生疼痛（E对），但没有自发痛。